患者男，40岁，脑外伤后癫痫病史4年，采用卡马西平和妥泰联合治疗临床完全无发作已2年，如果再发作你认为最常见的原因是
A. 撤药发作
B. 睡眠减少
C. 感染
D. 饮酒
E. 疲劳

正确答案：A。撤药发作

解析：癫痫的治疗目前仍以药物治疗为主要手段，80%患者通过药物治疗可以控制癫痫。其治疗应达到以下目标：控制发作或最大限度地减少发作次数；长期治疗无明显不良反应；使患者保持或恢复原有的生理、心理和社会功能状态。半年内发作2次以上者，一旦诊断成立，即用药以控制发作，主张单药治疗，长期坚持服用，至少2年不发作后可逐步减量至停药，若2年再发作的最常见原因是撤药发作（A对，BCDE错）。